甲状旁腺的生理功能是
A. 促进钙磷经肠道吸收作用增强
B. 抑制肾曲小管对磷的吸收，增进对钙的重吸收
C. 抑制骨盐溶解，使血清钙含量降低
D. 使7-脱氢维生素D₃变为维生素D₃
E. 促进维生素D₃转化为25-羟维生素D₃

正确答案：B。抑制肾曲小管对磷的吸收，增进对钙的重吸收

解析：本题考查甲状旁腺的生理功能。甲状旁腺的功能是分泌甲状旁腺激素，调节身体里的钙磷代谢，抑制肾曲小管对磷的吸收，增进对钙的重吸收（B对ACDE错），所以有保钙和排磷的作用。